处方正文内容包括
A. 患者姓名、性别、年龄、临床诊断、开具日期
B. 执业医师签名、执业药师签名、收费人员签名
C. 患者身份证号、代办人员的姓名及身份证号
D. 药品名称、剂型、规格、数量、用法用量
E. 药品不良反应、药品的禁忌症

正确答案：D。药品名称、剂型、规格、数量、用法用量

解析：本题考查处方内容。药品名称、剂型、规格、数量、用法用量（D对）是处方的正文内容。完整的处方由三部分组成，分别是处方前记、处方正文和处方后记。患者姓名、性别、年龄、临床诊断、开具日期（A错），患者身份证号、代办人员的姓名及身份证号（C错）是处方的前记内容。执业医师签名、执业药师签名、收费人员签名（B错）是处方的后记内容。